胃脘疼痛，口中泛酸，嗳气则舒，其临床意义是
A. 肝胆实热
B. 脾胃湿热
C. 肝胃蕴热
D. 脾虚不运
E. 食积内停

正确答案：C。肝胃蕴热

解析：本题考查的是口味异常的临床意义。胃脘疼痛，口中泛酸，嗳气则舒，其临床意义是肝胃蕴热（C对）。口味异常的临床意义：主要是询问患者口中的异常味觉与气味。口苦，多见于热证，特别是常见于肝胆实热（A错）的病变；口甜而腻，多属脾胃湿热（B错）；口中泛酸，多为肝胃蕴热；口中酸馊，多为食积内停（E错）；口淡乏味，常见于脾虚不运（D错）。